牙周探诊深度是指
A. 龈缘至膜龈联合的距离
B. 牙周袋底至牙槽骨嵴顶的距离
C. 牙周袋底至釉牙骨质界的距离
D. 游离龈沟底至膜龈联合的角化牙龈的距离
E. 龈缘至牙周袋底的距离

正确答案：E。龈缘至牙周袋底的距离

解析：本题考查牙周探诊深度。牙周探诊深度是指龈缘至牙周袋底的距离（E对）。探诊深度：使用专用的牙周探针所测得的龈袋或牙周袋的深度，即龈缘至袋底或龈沟底的距离，是重要的牙周临床指标。